产褥期抑郁症肝郁脾虚证治疗方剂为
A. 甘麦大枣汤合归脾汤
B. 逍遥散
C. 癫狂梦醒汤
D. 百合地黄汤
E. 越鞠丸

正确答案：B。逍遥散

解析：产褥期抑郁症的肝郁气结证主因素性忧郁，产后复因情志所伤，或突受惊吓，魂不守舍所致。治宜疏肝解郁，镇静安神。方用疏肝解郁，养血健脾之逍遥散加镇静安神的夜交藤、合欢皮、磁石、柏子仁（B对）。产褥期抑郁症心脾两虚证的治疗方剂为归脾汤（A错）《太平惠民和剂局方》加夜交藤、合欢皮、磁石、柏子仁；产褥期抑郁症痰阻气逆证的治疗方剂为癫狂梦醒汤（C错）《医林改错》加酸枣仁；百合地黄汤（D错）滋阴清热，主治百合病；越鞠丸（E错）行气解郁，治疗六郁证。